环境卫生学研究的核心问题是环境质量对下列哪一项的影响
A. 生物群落
B. 人群健康
C. 社会经济
D. 生态环境
E. 可持续发展

正确答案：B。人群健康

解析：本题考查环境卫生学研究的核心问题。环境效应评价包括环境质量对生物群落、人群健康、社会经济等方面的影响，其中环境质量对人群健康（B对ACDE错）影响尤为重要，是环境卫生学研究的核心问题。